具有攻毒杀虫，祛风止痛功效的药物是
A. 樟脑
B. 螗蜍
C. 白矾
D. 雄黄
E. 蜂房

正确答案：E。蜂房

解析：蜂房具有攻毒杀虫，祛风止痛的功效（E对）。樟脑具有除湿杀虫，温散止痛，开窍辟秽的功效（A错）。蟾酥具有解毒，止痛，开窍醒神的功效（B错）。白矾具有外用解毒杀虫，燥湿止痒；内服止血，止泻，化痰的功效（C错）。雄黄具有解毒，杀虫（D错）。